手太阴肺经下接
A. 手厥阴心包经
B. 手阳明大肠经
C. 足少阳胆经
D. 足阳明胃经
E. 足太阴脾经

正确答案：B。手阳明大肠经

解析：本题考查的是十二经脉的交接规律。手太阴肺经下接手阳明大肠经（B对）。十二经脉的交接规律：（1）相为表里的阴经与阳经在指趾端相交接：手太阴肺经在食指端与手阳明大肠经交接，手少阴心经在小指端与手太阳小肠经交接，手厥阴心包经（A错）在无名指端与手少阳三焦经交接。足阳明胃经（D错）在足大趾与足太阴脾经（E错）交接，足太阳膀胱经在足小趾与足少阴肾经交接，足少阳胆经（C错）在足大趾爪甲后丛毛处与足厥阴肝经交接。（2）同名的手、足阳经在头面部相交接：手阳明大肠经和足阳明胃经交接于鼻旁，手太阳小肠经和足太阳膀胱经交接于目内眦，手少阳三焦经和足少阳胆经交接于目外眦。（3）手、足阴经在胸部交接：足太阴脾经与手少阴心经交接于心中，足少阴肾经与手厥阴心包经交接于胸中，足厥阴肝经与手太阴肺经交接于肺中。